治疗饮食积滞，泻痢腹痛，首选药物是
A. 莱菔子
B. 麦芽
C. 神曲
D. 山楂
E. 鸡内金

正确答案：D。山楂

解析：五种药均为消食药，山楂酸、甘，微温，善消食化积，能治各种饮食积滞，尤为消肉食之要药，还能行气散结止痛，炒用兼能止泻止痢，为治疗饮食积滞，泻痢腹痛首选药（D对）；莱菔子辛、甘，平，消食行气化痰，用于治疗饮食停滞，脘腹胀痛，痰壅喘咳（A错）；麦芽甘、平，善消米面薯芋类食积，还可用于治疗乳房胀痛、断乳，肝气郁滞或肝胃不和而致的胁痛、脘腹痛（B错）；神曲甘、辛，温，消食降气，主治饮食积滞（C错）；鸡内金甘平，健胃消食，涩精止遗，通淋化石，主治饮食积滞，小儿疳积，肾虚遗精、遗尿，石淋（E错）。